将多种渠道筹集的经费（保险费）集中起来形成基金（医疗保险基金），用于补偿个人（被保险人）因病或其他损伤所造成的经济损失的一种制度，称为
A. 养老保险
B. 社会福利
C. 社会保险
D. 医疗保险
E. 商业保险

正确答案：D。医疗保险

解析：医疗保险是将多种渠道筹集的经费（保险费）集中起来形成基金（医疗保险基金），用于补偿个人（被保险人）因病或其他损伤所造成的经济损失的一种制度。掌握“医疗保障”知识点。